某年夏季，某县中心小学47名学生相继出现剧烈呕吐、上腹部剧烈疼痛、腹泻等症状，少数患者有低热。调查得知发病学生在当天上午均吃过学校供应的课间餐（外购的奶油蛋糕），未吃者不发病。患者发病的潜伏期最短为1小时，最长为6小时。针对这起食物中毒事件，主要的治疗措施为
A. 应用多价抗毒素血清
B. 服用改变肠道菌群的制剂
C. 应用止痛剂
D. 彻底洗胃、灌肠
E. 静脉补充水、电解质，静脉输注抗生素

正确答案：E。静脉补充水、电解质，静脉输注抗生素

解析：本次食物中毒发生在夏季，是细菌性食物中毒好发季节。患者发病潜伏期在1～6小时之间，发病学生均吃过外购的奶油蛋糕，未吃者不发病，考虑中毒食品应该是奶油蛋糕。最易引起奶油蛋糕污染的细菌是金黄色葡萄球菌。金葡菌中毒治疗方法按一般急救处理的原则，轻者以补水和维持电解质平衡为主，重者还应采用有效的抗生素（E对）。应用多价抗毒素血清是针对肉毒中毒患者，金葡菌中毒无特效血清（A错）。改变肠道菌群的制剂在治疗儿童腹泻时使用（B错）。细菌性食物中毒的腹痛不需要用止痛剂（C错）。彻底洗胃、灌肠适宜用于化学性食物中毒或农药中毒时（D错）。